白蔹的性状特征有
A. 纵瓣呈长圆形或近纺锤形
B. 切面类白色或淡红棕色，中部有一条凸起的棱线
C. 外皮红棕色或红褐色，易层层脱落；切面周边常向内卷曲
D. 体轻，质硬脆，易折断
E. 气特异，味微苦

正确答案：A、B、C、D。纵瓣呈长圆形或近纺锤形；切面类白色或淡红棕色，中部有一条凸起的棱线；外皮红棕色或红褐色，易层层脱落；切面周边常向内卷曲；体轻，质硬脆，易折断